某男患者，65岁。患胃癌四年，晚期，已失去手术治疗价值，生命垂危。家属再三恳求医生，希望能满足病人心理上的渴求，收他入院。医生出于“人道”，将他破格地收入院。究竟该不该收治这个病人。按医院的职能和任务要求，下列哪点是不对的
A. 医院担负治病救人的任务，应该收治这个病人
B. 医院对所有患者都应一视同仁
C. 治愈率、床位周转率是考核医院效益的指标，因而不能收治晚期癌症病人
D. 患者家属已同意支付医药费，对医院经济利益无影响
E. 在医院内，患者有安全感，心理状态好

正确答案：C。治愈率、床位周转率是考核医院效益的指标，因而不能收治晚期癌症病人